生活事件、日常困扰属于
A. 环境性应激源
B. 心理性应激源
C. 社会性应激源
D. 职业性应激源
E. 生活性应激源

正确答案：C。社会性应激源

解析：社会性应激源：生活事件、日常困扰、重大变故和文化冲突等。掌握“心理应激”知识点。